代表心室除极和复极总时间的是
A. P波
B. QRS波群
C. S-T段
D. T波
E. Q-T间期

正确答案：E。Q-T间期

解析：代表心室除极和复极总时间的是Q-T间期（E对）。P波反应心房的除极过程（A错）。QRS波群反应心室除极过程（B错）。S-T段反应心室的缓慢复极过程（C错）。T波反应了心室的快速复极过程（D错）。